有季节性升高，并以儿童多见的传染病，传播途径是
A. 经水传播
B. 经食物传播
C. 经接触传播
D. 经空气传播
E. 经土壤传播

正确答案：D。经空气传播

解析：本题考查经空气传播的传染病流性特征。有季节性升高，并以儿童多见的传染病，传播途径是经空气传播（D对ABCE错）。经空气传播的传染病流行特征为：①传播途径容易实现，传播广泛，发病率高；②有明显的季节性，冬春季高发；③在没有免疫预防人群中，发病呈周期性；④居住拥挤和人口密度大的地区高发。